患者腹部膨隆呈球形，转动体位时形状改变不明显。应首先考虑的是
A. 肝硬化
B. 右心功能不全
C. 缩窄性心包炎
D. 肾病综合征
E. 肠麻痹

正确答案：E。肠麻痹

解析：肠麻痹（E对）时，全腹膨隆，使腹部呈球形，两侧腹部膨出不明显，移动体位时其形状无明显改变。肝硬化（A错）、右心功能不全（B错）缩窄性心包炎（C错）、肾病综合征（D错）引起的腹部膨隆在转动体位时形状可改变。